由涉水产品带入饮用水中的有害物质无依据可确定容许限值时，需进行
A. 流行病学调查
B. 毒理学试验
C. 浸泡试验
D. 致畸试验
E. 致癌试验

正确答案：B。毒理学试验

解析：本题考查毒理学评价的相关内容。毒理学安全性评价是通过动物试验和对人群的观察，阐明待评物质的毒性及潜在的危害，决定其能否进入市场或阐明安全使用的条件，以达到最大限度的减小其危害作用、保护人民身体健康的目的。由涉水产品带入饮用水中的有害物质无依据可确定容许限值时，需进行毒理学评价（B对ACDE错）。根据涉水产品在水中溶出物质的浓度，毒理学安全性评价分四个水平进行，以确定其在水中的最大容许浓度。